吗啡对中枢神经系统的作用是
A. 镇痛，镇静，催眠，呼吸抑制，止吐
B. 镇痛，镇静，镇咳，缩瞳，致吐
C. 镇痛，镇静，镇咳，呼吸兴奋
D. 镇痛，镇静，止吐，呼吸抑制
E. 镇痛，镇静，扩瞳，呼吸抑制

正确答案：B。镇痛，镇静，镇咳，缩瞳，致吐

解析：吗啡对中枢神经系统作用包括：镇痛作用、镇静、致欣快作用、抑制呼吸、镇咳、缩瞳、其他中枢作用：吗啡作用于下丘脑体温调节中枢，可使体温略有降低；兴奋延髓催吐化学感受区，引起恶心和呕吐；抑制下丘脑释放促性腺激素释放激素（GnRH）和促肾上腺皮质激素释放激素（CRF），从而降低血浆促肾上腺皮质激素（ACTH）、黄体生成素（LH）、促卵泡激素（IFSH）的浓度。掌握“吗啡、哌替啶”知识点。